以下关于间接固位体的表述中正确的是
A. 间接固位体与游离端基托位于支点线的同侧，距支点线越远对抗转动的力越强
B. 间接固位体与游离端基托位于支点线的同侧，距支点线越近对抗转动的力越强
C. 间接固位体与游离端基托位于支点线的两侧，距支点线越远对抗转动的力越强
D. 间接固位体与游离端基托位于支点线的两侧，距支点线越近对抗转动的力越强
E. 间接固位体与游离端基托位于支点线的两侧，距支点线越远对抗转动的力越弱

正确答案：C。间接固位体与游离端基托位于支点线的两侧，距支点线越远对抗转动的力越强

解析：间接固位体与支点线的关系：支点线到游离端基托远端的垂直距离最好等于支点线到间接固位体的垂直距离。间接固位体距支点线的垂直距离愈远，对抗转动的力愈强。掌握“局部义齿人工牙及基托”知识点。